可使新生儿出现灰婴综合征的药物是
A. 氯霉素
B. 新生霉素
C. 磺胺嘧啶
D. 葡萄糖
E. 苯巴比妥

正确答案：A。氯霉素

解析：本题考查药物的不良反应。可使新生儿出现灰婴综合征的药物是氯霉素（A对）。新生儿因葡糖醛酸结合酶不足，应用氯霉素可能出现厌食、呕吐、腹胀，进而发展为循环衰竭，全身呈灰色，称为“灰婴综合征”。新生霉素（B错）主要不良反应是过敏反应。磺胺嘧啶（C错）的典型不良反应是核黄疸。新生儿使用苯巴比妥（E错）容易中毒，是由于新生儿血浆蛋白结合药物能力差，游离型苯巴比妥血药浓度过高所致。